下列药物属阳的是
A. 补中益气
B. 清热导滞
C. 降气收敛
D. 消积导滞
E. 降逆收敛

正确答案：A。补中益气

解析：本题考查的是阴阳与药物性能的关系。下列药物属阳的是补中益气（A对）。升和浮、沉和降，都是相对的。升是上升，降是下降，浮表示发散向外，沉表示收敛固藏和泻利等。升浮属阳，沉降属阴。一般说，升浮类药能上行向外，分别具有升阳发表、祛风散寒、涌吐、开窍等作用；沉降类药能下行向内，分别具有泻下、清热（B错）、利水渗湿、重镇安神、潜阳息风、消积导滞（D错）、降逆止呕、收敛（CE错）固涩、止咳平喘等作用。